急性牙髓炎的治疗
A. 开髓开放
B. 开髓封失活剂
C. 开髓拔髓开放
D. 麻醉拔髓+根管封药
E. 开髓开放+切开引流

正确答案：A。开髓开放

解析：本题考查急性牙髓炎的应急处理。急性牙髓炎的治疗为开髓开放（A对）。急性牙髓炎应急处理的目的是引流炎症渗出物和缓解因之而形成的髓腔高压，以减轻剧痛。可在局麻下开髓，去除全部或大部分牙髓后放置一无菌小棉球并暂封髓腔，患牙的疼痛随即缓解。对于单根牙，拔髓后可以进行根管预备和封药后再暂封。